医务人员特别是护理人员最常见的安全事件是
A. 化学伤害
B. 锐器伤
C. 生物伤害
D. 电离辐射
E. 中毒

正确答案：B。锐器伤

解析：医务人员职业暴露环境中的危险因素包括物理因素、化学因素、生物因素、社会心理因素，物理因素中的锐器伤（B对ACDE错）是医务人员、特别是护理人员最常见的，电离辐射是造成医务人员特别是放射专业人员职业危害的重要物理因素，因消毒剂所致的化学伤害轻者引起皮炎、鼻炎、哮喘，重者引起中毒或致癌。